能清热润肺、止咳化痰的是
A. 川贝母
B. 浙贝母
C. 两者均是
D. 两者均不是

正确答案：A。川贝母

解析：本题考查的是川贝母的功效。能清热润肺、止咳化痰的是川贝母（A对）。川贝母：【功效】清热化痰，润肺止咳，散结消痈。浙贝母（B错）：【功效】清热化痰，散结消肿。